有关DIC发病机制，下列哪一项说法不妥？
A. 组织损伤
B. 肝功能严重障碍
C. 血细胞损伤
D. 急性胰腺炎、羊水栓塞等其他激活凝血系统的途径
E. 血管内皮细胞的损伤或激活

正确答案：B。肝功能严重障碍

解析：组织损伤（A对）可释放大量组织因子入血，激活外源性凝血系统，启动凝血过程，促进DIC。血细胞损伤（C对）血小板被激活，促进DIC。急性胰腺炎、羊水栓塞等其他激活凝血系统的途径（D对）使促凝物质进入血液，促进DIC。血管内皮细胞的损伤或激活（E对）凝血、抗凝调控失调，促进DIC。肝功能严重障碍（B错，为本题正确答案）不是有关DIC发病机制,而是影响 DIC 发生发展的因素。